预防职业中毒的中心环节是
A. 通风排毒
B. 降低空气中毒物浓度
C. 个人防护
D. 安全生产管理
E. 个人卫生

正确答案：B。降低空气中毒物浓度